硬膜下积液
A. 1岁之内患儿患化脑易合并
B. 结核性脑膜炎
C. 脑膜炎双球菌脑炎
D. 脑室管膜炎
E. 脑炎链球菌性脑膜炎

正确答案：A。1岁之内患儿患化脑易合并

解析：硬脑膜下积液为化脓性脑膜炎的并发症多见于1岁以内的肺炎链球菌和流感冒嗜血杆菌脑膜炎患儿，临床往往出现在治疗中体温不降，或热退后复升，进行性前囟饱满，颅缝分离，头围增大，呕吐，惊厥，意识障碍等（A对）。结核性脑膜炎的并发症为继发性癫痫、偏瘫、脑积水（B错）。脑膜炎双球菌脑炎并发症为脑内积水、中耳炎、眼炎（C错）。脑室管膜炎为化脓性脑膜炎的并发症（D错）。脑炎链球菌性脑膜炎并发症为硬脑膜下积液、积脓或脑积水。严重者发生脑梗死，脑室积脓、脑水肿，脑疝（E错）。